对人类生活的影响最大，与人类关系最密切的是
A. 对流层
B. 平流层
C. 中间层
D. 热成层
E. 逸散层

正确答案：A。对流层

解析：本题考查大气层。人类活动排入大气的污染物绝大多数在对流层聚集。因此，对流层（A对BCDE错）对人类生活的影响最大，与人类关系最密切。